肾中精气的主要生理功能是
A. 促进机体的生长发育
B. 促进生殖机能的成熟
C. 主生长发育和生殖
D. 化生血液的物质基础
E. 人体生命活动的根本

正确答案：C。主生长发育和生殖

解析：肾中精气主司机体的生长发育仅为肾中精气的生理功能之一（A错）。肾中精气充盛到一定程度可以产生天癸，促进生殖机能的成熟，是肾中精气的生理功能之一（B错）。肾中精气具有促进机体的生长、发育和生殖的作用，（C对）。营气和津液是化生血液的主要物质基础，肾精也是化生血液的物质基础，是在肾阳的作用下而化生的（D错）。心为人体生命活动的根本（E错）。